成年男性右侧膝关节以下烧伤，其烧伤面积占人体体表面积的百分比
A. 5%
B. 6%
C. 8%
D. 10%
E. 13%

正确答案：D。10%

解析：根据中国新九分法（P138表13-1），成年男性双小腿表面积占全身体表面积的13%，双足占7%（女性双足占6%），故右侧膝关节以下即右小腿和右足的表面积，约占体表表面积的（13%+7%）/2=10%（D对）。